对高血压合并糖尿病宜选用
A. 噻嗪类利尿剂
B. 醛固酮受体拮抗剂
C. 血管紧张素转换酶抑制剂
D. α受体阻断剂
E. β受体阻断剂

正确答案：C。血管紧张素转换酶抑制剂

解析：本题考查降压药的使用。对高血压合并糖尿病宜选用血管紧张素转换酶抑制剂（C对）。高血压合并糖尿病首先考虑使用ACEI或ARB；如需联合用药，应以ACEI或ARB为基础，加用利尿剂或二氢吡啶类CCB。噻嗪类利尿剂（A错）和醛固酮受体拮抗剂（B错）适用于老年高血压、单纯收缩期高血压等。α受体阻断剂（D错）适用高血压伴前列腺增生患者。β受体阻断剂（E错）适用于高血压合并心力衰竭。